检测患者血清等标本或病毒培养物中病毒基因或核酸片段的技术包括
A. 病毒核酸扩增试验
B. 核酸杂交技术
C. 基因芯片技术
D. 病毒基因测序
E. 以上均包括

正确答案：E。以上均包括

解析：检测患者血清等标本或病毒培养物中病毒基因或核酸片段的技术有多种：①病毒核酸扩增试验即：聚合酶链反应（PCR）；②核酸杂交技术，包括点杂交、原位杂交、DNA-DNA印迹杂交（Southern　blot）及RNA-DNA印迹杂交等；③基因芯片技术（gene　chip）；④病毒基因测序等。目前，分子生物学技术日益广泛地应用于对病毒及其感染的检测和研究中。掌握“病毒感染检查方法及防治原则”知识点。